除哪项外均为突发公共卫生事件的特征
A. 突发性
B. 准备和预防的困难性
C. 处置和结局的复杂性
D. 表现呈多样性
E. 个体性

正确答案：E。个体性